霍奇金病特征性的热型是
A. 间歇热
B. 稽留热
C. 弛张热
D. 周期性发热
E. 不规则热

正确答案：D。周期性发热

解析：霍奇金病（霍奇金淋巴瘤）特征性的热型为周期性发热（D对）。间歇热（九版诊断学P10）（A错）常见于疟疾、急性肾盂肾炎等疾病；稽留热（九版诊断学P10）（B错）常见于大叶性肺炎、斑疹伤寒、伤寒高热期等疾病；弛张热（九版诊断学P10）（C错）常见于败血症、风湿热、重症肺结核、化脓性炎症等疾病；不规则热（九版诊断学P11）（E错）常见于结核病、风湿热、支气管肺炎等疾病。